治疗甲状腺功能亢进症心肝阴虚证且对抗甲状腺药物过敏者，应首选
A. 他巴唑加天王补心丹
B. 碘加天王补心丹
C. 他巴唑加六味地黄丸
D. 他巴唑加消瘿丸
E. 碘液加天王补心丹

正确答案：B。碘加天王补心丹

解析：对抗甲状腺药物过敏者不能再使用抗甲状腺药物治疗，他巴唑是抗甲状腺药物中的咪唑类（ACD错）。治疗甲状腺功能亢进症心肝阴虚证，治宜滋阴降火，消瘿散结，天王补心丹对症；对抗甲状腺药物过敏者，应首选放射性碘治疗，适应于25岁以上，中度甲亢，ATD治疗无效或ATD过敏者（B对E错）。